校园绿化用地小学生每人不应少于
A. 0.5m²
B. 1m²
C. 1.1m²
D. 2.3m²
E. 3.3m²

正确答案：A。0.5m²